患儿发热，流涕，偶有咳嗽，大便呈稀水蛋花样，无腥臭味。应首先考虑的是
A. 大肠杆菌性肠炎
B. 病毒性肠炎
C. 金黄色葡萄球菌肠炎
D. 霉菌性肠炎
E. 生理性腹泻

正确答案：B。病毒性肠炎

解析：病毒性肠炎是一组由多种病毒引起的急性肠道传染病，临床特点为起病急，恶心、呕吐、腹痛、腹泻，排水样便或稀便，也可有发热及全身不适等症状。因细菌性肠炎大便多有腥臭味，结合本证患儿大便无腥臭味，亦未说明相关特殊用药史，排除细菌性肠炎，故应首先考虑病毒性肠炎（B对）。大肠杆菌性肠炎（A错）临床表现为体温不规则，38～40℃持续数天，每天腹泻10～20次，常为黄绿色水样便，混有少量黏液，可有腥臭味，多有恶心呕吐，可有脱水及酸中毒表现，本证临床表现与之不符。金黄色葡萄球菌肠炎（C错）因长期使用抗生素引起的肠道菌群失调所致，轻者大便次数稍多，为黄绿色糊状便，重者大便次数频繁，每日可达数十次，大便呈暗绿色水样便，外观像海水，黏液多，有腥臭味，有时可排除伪膜，本证临床特点与之不符。霉菌性肠炎（D错）常继发于鹅口疮，大多发生在应用抗生素治疗后，轻者腹泻水样，重者水样便中可见伪膜，除消化道症状外，尚可见皮肤感染征象，本证临床特点与之不符。生理性腹泻（E错）多见于6个月以内婴儿，外观虚胖，常有湿疹，生后不久即出现腹泻，除大便次数增多，无其他症状，食欲好，不影响生长发育，本证临床特点与之不符。